不良生殖结局是指
A. 异常妊娠结局和不孕
B. 子代发育异常
C. 低体重儿
D. 流产、早产、死产
E. 月经周期改变

正确答案：A。异常妊娠结局和不孕